为研究肺癌的病因，将肺癌病例与非病例对照按年龄、性别、居住地及社会等级配比，然后对两组观察对象情况进行比较，这是下列哪一项研究
A. 现况研究
B. 定群研究
C. 病例对照研究
D. 临床实验
E. 以上都不是

正确答案：C。病例对照研究